齿状线是直肠肛管的重要分界线，许多解剖结构中，不以齿状线为分界的是
A. 直肠上动脉与直肠下动脉
B. 直肠上静脉与直肠下静脉
C. 直肠与肛管的淋巴引流
D. 局部的交感副交感神经与阴部神经
E. 直肠上静脉与直肠下静脉肛管静脉

正确答案：A。直肠上动脉与直肠下动脉

解析：直肠肛管在齿状线以下的动脉供应为肛管动脉；齿状线以上的动脉供应主要为直肠上动脉、直肠下动脉和骶正中动脉，因此直肠上动脉与直肠下动脉（A错，为本题正确答案）不以齿状线为分界。直肠上静脉收集齿状线以上直肠上静脉丛的血液，直肠下静脉、肛管静脉收集齿状线下直肠下静脉丛的血液（BE对）。直肠与肛管的淋巴引流（C对）以齿状线为界，齿状线以上淋巴引流入腹主动脉旁淋巴结、髂内淋巴结，齿状线以下淋巴引流入腹股沟淋巴结、髂外淋巴结。阴部神经分支支配齿状线以下的肛管及其周围结构，交感神经、副交感神经支配齿状线以上的直肠粘膜（D对）。